不与上颌骨相连的骨是
A. 颧骨
B. 额骨
C. 蝶骨
D. 梨骨
E. 颞骨

正确答案：E。颞骨

解析：上颌骨位于颜面中部，左右各一，相互对称。与颧骨、额骨、蝶骨、鼻骨、梨骨、泪骨、腭骨等邻接，参与眶底、口腔顶的大部分、鼻腔底部和外侧壁、部分颞下窝和翼腭窝、翼上颌裂及眶下裂的构成。掌握“上颌骨解剖特点”知识点。